导致发生中药不良反应的药物因素和使用因素有
A. 用错品种
B. 炮制不当
C. 剂量过大
D. 配伍失度
E. 辨证错误

正确答案：A、B、C、D、E。用错品种；炮制不当；剂量过大；配伍失度；辨证错误

解析：本题考查的是引起中药不良反应发生的因素。导致发生中药不良反应的药物因素和使用因素有用错品种（A对）、炮制不当（B对）、剂量过大（C对）、配伍失度（D对）与辨证错误（E对）。引起中药不良反应发生的因素：（一）药物相关因素：1.基源与品种；2.药材产地；3.采集时间；4.炮制工艺；5.贮存条件；6.药物的成分；7.药品质量。（二）患者机体因素：1.生理因素；2.遗传因素；3.病理因素。（三）临床使用因素：1.剂量过大；2.疗程过长；3.辨证不准；4.配伍失度。